血液运行所依赖的生理功能有
A. 肝藏血
B. 脾统血
C. 肝主疏泄
D. 心主血脉
E. 肺朝百脉

正确答案：A、B、C、D、E。肝藏血；脾统血；肝主疏泄；心主血脉；肺朝百脉